丁型肝炎的潜伏期是
A. 2～6周
B. 4～24周
C. 4～20周
D. 2～9周
E. 2～26周

正确答案：C。4～20周

解析：各型肝炎潜伏期：甲型肝炎2～6周（A错），平均4周；乙型肝炎1～6个月（B错），平均为3个月；丙型肝炎2周～6个月（E错），平均40天；丁型肝炎4～20周（C对）；戊型肝炎2～9周（D错），平均6周。